关于氯丙嗪降温作用的表述，错误的是
A. 降低发热者的体温
B. 降低正常人的体温
C. 降温作用与环境温度无关
D. 抑制体温调节中枢
E. 抑制机体对寒冷刺激的反应

正确答案：C。降温作用与环境温度无关